囊虫病的传染源是
A. 猪肉绦虫病患者
B. 牛肉绦虫病患者
C. 囊虫病患者
D. 猪
E. 牛

正确答案：A。猪肉绦虫病患者